右旋糖酐40氯化钠注射液中，右旋糖酐40的含量测定方法是
A. 滴定分析法
B. 旋光度法
C. 紫外-可见分光光度法
D. 高效液相色谱法
E. 生物检定法

正确答案：B。旋光度法

解析：本题考查右旋糖酐40氯化钠注射液的含量测定方法。右旋糖酐40氯化钠注射液为复方制剂，利用制剂中右旋糖酐40有旋光性，而氯化钠无旋光性不干扰测定的原理，用旋光度法（B对）直接测定右旋糖酐40的含量。滴定分析法（A错）用于右旋糖酐40氯化钠注射液中氯化钠的含量测定。